下列关于躁狂症的描述，哪项不正确
A. 具有感染力
B. 可情绪反应不稳定
C. 注意力增强，持久
D. 病前可有乏力，失眠等症状
E. 起病呈急性或亚急性

正确答案：C。注意力增强，持久